男性，40岁，左侧慢性脓胸伴左下肺支气管扩张，左下肺不张，左下肺支气管胸膜瘘。最适宜的手术方式是
A. 支气管瘘缝合术
B. 胸膜纤维板剥除术病
C. 胸廓改形术
D. 病肺切除加胸膜纤维板剥除术
E. 左下肺叶切除术

正确答案：D。病肺切除加胸膜纤维板剥除术

解析：慢性脓胸的治疗原则有：①改善全身情况，消除中毒症状和营养不良；②消除致病原因和脓腔；③尽力使受压的肺复张，恢复肺的功能。患者左侧慢性脓胸已合并有严重肺内病变（支气管扩张、肺不张、支气管胸膜瘘），故对于该患者最适宜的手术方式是病肺切除加胸膜纤维板剥除术（D对）。病肺切除消除了病因和脓腔；胸膜纤维板剥除术可剥除脓腔壁胸膜和脏胸膜上的纤维板，使肺得以复张，改善了肺功能和胸廓呼吸运动。支气管瘘缝合术（A错）只是对症处理，不能从根源上消除慢性脓胸的病变进展。单纯胸膜纤维板剥除术（B错）只适用于病期不长、纤维板粘连不甚紧密的病人，该患者已有严重肺内病变，故效果不佳。胸廓改形术（C错）不仅要切除覆盖在脓腔上的肋骨，而且也要切除增厚的壁胸膜纤维板，术式创伤较大，目前已很少使用。左下肺叶切除术（E错）不能同时处理脓胸。